具有行气止痛，温肾纳气功效的药物是
A. 香附
B. 青皮
C. 沉香
D. 木香
E. 佛手

正确答案：C。沉香

解析：该题考查理气药的功效，属记忆内容。沉香味辛、苦，性温；归脾、胃、肾经；具有行气止痛，降逆调中，温肾纳气的功效（C对ABDE错）。